气不内守，称为
A. 气陷
B. 气逆
C. 气结
D. 气脱
E. 气闭

正确答案：D。气脱

解析：本题考查的是气机失调。气不内守，称为气脱（D对）。气行失常，可涉及五脏六腑、表里内外、四肢九窍等各方面的多种病变。一般概括为：气滞、气逆、气陷、气闭和气脱等。气的运行不畅，或在局部郁滞不通，称作“气滞”。气的升降失常，若上升太过或下降不及，称作“气逆（B错）”；上升不及或下降太过，称作“气陷（A错）”。气的出入失常，若外出太过而不能内守，称作“气脱”；不能外达而郁结闭塞于内，称作“气闭（E错）”。